血中极低密度脂蛋白（VLDL）、低密度脂蛋白（LDL）、TC、TG均升高的病症是
A. Ⅰ型高脂蛋白血症
B. Ⅱa型高脂蛋白血症
C. Ⅱb型高脂蛋白血症
D. Ⅲ型高脂蛋白血症
E. Ⅳ型高脂蛋白血症

正确答案：C。Ⅱb型高脂蛋白血症